下列哪项不是伤寒的常见并发症
A. 肠出血
B. 肠穿孔
C. 中毒性肝炎
D. 血栓性静脉炎
E. 中毒性心肌炎

正确答案：D。血栓性静脉炎

解析：伤寒可以并发血栓性静脉炎（D错，为本题正确答案），但相对其他选项来说，血栓性静脉炎较少见；其主要并发症包括肠出血（A对）、肠穿孔（B对）、中毒性肝炎（C对）、中毒性心肌炎（E对）、支气管炎和肺炎、溶血尿毒综合征，其他可见急性胆囊炎、血栓性静脉炎、骨髓炎、脑膜炎、肾盂肾炎偶尔发生，孕妇可见早产或流产。